原发性肝癌最多见的淋巴转移的部位是
A. 肝门
B. 胰周
C. 腹膜后
D. 主动脉旁
E. 锁骨上

正确答案：A。肝门

解析：原发性肝癌淋巴转移最多见于肝门（A对）。胰腺后（B错）、腹膜后（C错）、主动脉旁（D错）淋巴结均为次级引流淋巴结，因此较肝门淋巴结转移少。锁骨上（E错）淋巴结转移多为晚期远处转移征象。